有神经一肌肉阻断作用的是
A. 红霉素
B. 诺氟沙星
C. 盐酸金刚乙烷
D. 庆大霉素
E. 甲硝唑

正确答案：D。庆大霉素

解析：庆大霉素（D对）可与钙离子竞争和抑制乙酰胆碱释放，降低神经末梢运动终板对乙酰胆碱的敏感性，并可与钙离子结合，使体液中钙离子含量降低，产生神经肌肉阻滞作用。红霉素（A错）（P380）主要不良反应为胃肠道反应，一般无神经肌肉阻滞作用。诺氟沙星（B错）是喹诺酮类药物，其不良反应可有中枢神经系统毒性，表现为失眠、头晕、头痛等，无神经肌肉阻滞作用。盐酸金刚乙烷（C错）可有神经系统不良反应，表现为步态反常、精神愉快、运动过度、震颤、幻觉、意识模糊、惊厥等，无神经肌肉阻滞作用。甲硝唑（E错）（P403）不良反应一般较轻微，包括胃肠道反应、过敏反应、外周神经炎等，无神经肌肉阻滞作用。